既能治疗胸痹、结胸,又能治疗乳痈肿痛、肠痈、肺痈的中药是
A. 天南星
B. 海浮石
C. 瓜蒌
D. 桔梗
E. 浙贝母

正确答案：C。瓜蒌

解析：瓜蒌具有清热涤痰，宽胸散结，润燥滑肠的功效，应用于痰热咳喘 ，胸痹，结胸 ，肺痈，肠痈，乳痈的治疗（C对）。白僵蚕的应用于湿痰，寒痰证；风痰眩晕，中风，癫痫，破伤风（A错）。海浮石的应用于痰热咳喘 ，瘰疬，瘿瘤 ，血淋，石淋（B错）。桔梗的应用于咳嗽痰多，胸闷不畅；咽喉肿痛，失音；肺痈吐脓（D错）浙贝母的应用于风热、痰热咳嗽；瘰疬，瘿瘤，乳痈疮毒，肺痈（E错）。